医疗机构负责人在购销药品时暗自收取回扣，对其依法予以处分的机关是
A. 工商行政管理部门
B. 药品监督管理部门
C. 劳动保障管理部门
D. 卫生行政部门
E. 公安局

正确答案：D。卫生行政部门

解析：医疗机构执业期间如果出现违法状况，则均由卫生行政部门依法予以处分。掌握“医疗机构登记和校验及法律责任”知识点。